用化学位移和偶合常数等数据进行结构解析的谱学技术是
A. 红外光谱
B. 高效液相色谱
C. 质谱
D. 核磁共振谱
E. 紫外-可见吸收光谱

正确答案：D。核磁共振谱

解析：本题考查的是化学结构研究中采用的主要方法。用化学位移和偶合常数等数据进行结构解析的谱学技术是核磁共振谱（D对）。核磁共振谱：①氢核磁共振（¹H-NMR）：¹H-NMR测定中通过化学位移（δ）、谱线的积分面积以及裂分情况（重峰数及偶合常数J）可以提供分子中质子的类型、数目及相邻原子或原子团的信息，对中药化学成分的结构测定具有十分重要的意义。②碳核磁共振（¹³C-NMR）：与¹H-NMR一样，¹³C的信号化学位移也取决于周围的化学环境及电子密度，并可据此判断¹³C的类型。显然，改变某个¹³C核周围的化学环境或电子密度，如引入某个取代基，则该¹³C信号即可能发生位移（取代基位移）。位移的方向（高场或低场）及幅度已经累积了一定经验规律。常见的有苯的取代基位移、羟基的苷化位移和酰化位移等，在结构研究中均具有重要的作用。红外光谱（A错）：分子中价键的伸缩及弯曲振动将在光的红外区域，即4000～400cm⁻¹处引起吸收。测得的吸收图谱叫红外光谱（IR）。红外光谱主要用于鉴别分子中的特征官能团，某些情况下，IR光谱可用于区别芳环的取代方式、构型及构象等。高效液相色谱（B错）（HPLC）：是判断有效成分纯度的一种重要方法，具有样品用量小、操作时间快、灵敏度高和准确等优点。该方法发展迅速，同时具有分离和分析鉴定的用途，已成为中药化学的常规分析方法。质谱（C错）（MS）：可用于确定分子量及求算分子式和提供其他结构信息。质谱的电离技术发展较快，软电离成为当今质谱仪器的标配，例如，电喷雾电离（简称ESI）、大气压化学电离（APCI）、化学电离（简称CI）、场致电离（简称FI）、场解析电离（简称FD）、快速原子轰击电离（简称FAB）等，极大地拓宽了质谱的检测范围，对热不稳定的化合物的研究提供了新的技术。紫外-可见吸收光谱（E错）：对于分子中含有共轭双键、α,β-不饱和羰基（醛、酮、酸、酯）结构的化合物以及芳香化合物的结构鉴定来说是一种重要的手段，通常主要用于推断化合物的骨架类型，还可用于测定化合物的精细结构。